做嵌体牙体预备时，错误的做法是
A. 去尽病变腐质
B. 轴面最大周径线降至龈缘
C. 提供良好的固位形和抗力形
D. 适当磨改异常的对颌牙
E. 预防性扩展

正确答案：B。轴面最大周径线降至龈缘

解析：本题考查嵌体的牙体预备。做嵌体牙体预备时，错误的做法是轴面最大周径线降至龈缘（B错，为本题的正确答案）。将轴面最大周颈线降至龈缘，不是嵌体牙体预备的要求，而是铸造金属全冠颊舌面预备的要求，目的是为了消除倒凹。嵌体牙体预备，首先应去尽病变腐质（A对），然后进行预防性扩展（E对）以形成底平、壁直、点线角清楚的固位洞形，以提供良好的固位形和抗力形（C对）。做嵌体牙体预备时，应适当磨改异常的对颌牙（D对），否则可能会影响咬合关系的恢复。